利尿作用极弱，具有降低眼内压作用，可用于青光眼治疗的利尿剂是
A. 呋塞米
B. 螺内酯
C. 乙酰唑胺
D. 氢氯噻嗪
E. 甘露醇

正确答案：C。乙酰唑胺

解析：本题考查乙酰唑胺。利尿作用极弱，具有降低眼内压作用，可用于青光眼治疗的利尿剂是乙酰唑胺（C对）。乙酰唑胺为碳酸酐酶抑制剂，由于利尿作用弱，目前很少用于利尿。还可抑制睫状体上皮细胞中的碳酸酐酶，减少房水和脑脊液的产生，使眼压降低。主要用于治疗青光眼和脑水肿。呋塞米（A错）是袢利尿剂，本类药物主要作用部位在髓袢升支粗段，干扰Na⁺-K⁺-2Cl⁻共同转运系统，产生强大的利尿作用。螺内酯（B错）为醛固酮受体阻断剂，主要用于伴有醛固酮升高的顽固性水肿，如充血性心力衰竭、肝硬化腹水及肾病综合征。氢氯噻嗪（D错）为中效利尿剂，临床用于水肿、高血压及尿崩症的治疗。甘露醇（E错）为渗透性利尿药，用于预防急性肾衰竭、脑水肿及青光眼，是治疗脑水肿、降低颅内压的安全而有效的首选药物。